易沿神经、血管扩散的肿瘤是
A. 沃辛瘤
B. 多形性腺瘤
C. 腺样囊性癌
D. 腺泡细胞癌
E. 黏液表皮样癌

正确答案：C。腺样囊性癌

解析：腺样囊性癌肿瘤易沿神经扩散，肿瘤浸润性极强，肿瘤易侵入血管，造成血行性转移，转移率高达40%，为口腔颌面部恶性肿瘤中血液循环转移率较高的肿瘤之一，转移部位以肺为最多见。掌握“腺样囊性癌”知识点。